从同一总体中随机抽取若干个观察单位数相等的样本，由于抽样引起样本均数与总体均数及样本均数之间的差异称作
A. 均数的标准误
B. 标准差
C. 均数的平均值
D. 均数的抽样误差
E. 均数平均数

正确答案：D。均数的抽样误差

解析：从同一总体中随机抽取若干个观察单位数相等的样本，由于抽样引起样本均数与总体均数及样本均数之间的差异称作均数的抽样误差，掌握“定量资料的统计描述和推断”知识点。